临床上可代替去甲肾上腺素用于各种休克早期的药物是
A. 麻黄碱
B. 肾上腺素
C. 间羟胺
D. 异丙肾上腺素
E. 去甲肾上腺素

正确答案：C。间羟胺

解析：间羟胺由于升压作用持久，对肾血管收缩作用较NA平缓，且较少引起心律失常及少尿等不良反应，还可肌内注射，故临床上可代替NA用于休克早期及手术后或脊椎麻醉后的休克（C对）。